可导致新生儿药物性黄疸的是
A. 头孢他啶
B. 阿莫西林
C. 林可霉素
D. 磺胺嘧啶
E. 罗红霉素

正确答案：D。磺胺嘧啶

解析：本题考查磺胺嘧啶的不良反应。可导致新生儿药物性黄疸的是磺胺嘧啶（D对）。由于磺胺类药物与胆红素竞争血浆蛋白结合部位，可致游离胆红素增高。新生儿肝功能不完善，故较易发生高胆红素血症和新生儿黄疸，偶可发生核黄疸。头孢他啶（A错）、阿莫西林（B错）、林可霉素（C错）、罗红霉素（E错）均无导致新生儿药物性黄疸的不良反应。